阴部瘙痒，带下量多，色黄如脓，稠黏臭秽，舌苔黄腻，脉弦数，其中医证型是
A. 肝肾阴虚型
B. 脾肾阳虚型
C. 湿热下注型
D. 湿虫滋生型
E. 津亏血少型

正确答案：C。湿热下注型

解析：患者阴部瘙痒，带下量多，色黄如脓，稠黏臭秽，可诊断为带下病湿热下注证，又根据其舌苔脉象舌苔黄腻，脉弦数符合湿热下注证型（C对）。阴虚夹湿证证候∶带下量多，色黄或赤白相兼，质稠，有气味，阴部有灼热感，或阴部瘙痒，腰酸腿软，头晕耳鸣，五心烦热，咽干口燥，或烘热汗出，失眠多梦。舌质红苔少或黄腻，脉细数（A错）。湿虫滋生证证候∶阴部瘙痒，如虫行状，甚则奇痒难忍，灼热疼痛，带下量多，色黄呈泡沫状，或色白如豆渣状，臭秽，心烦少寐，胸闷呃逆，口苦咽干，小便黄赤。舌红苔黄腻，脉滑数（D错）。脾肾阳虚证证候∶带下量多，绵绵不断，质清稀如水，腰酸如折，畏寒肢冷，小腹冷感，面色晦暗，小便清长，或夜尿多，大便潇薄。舌质淡苔白润，脉沉迟（B错）。